分泌降钙素的细胞是
A. 神经垂体细胞
B. 甲状旁腺细胞
C. 甲状腺滤泡旁细胞
D. 甲状腺滤泡细胞
E. 腺垂体细胞

正确答案：C。甲状腺滤泡旁细胞

解析：降钙素（CT）由甲状腺C细胞（或称滤泡旁细胞）（C对）分泌。神经垂体细胞（A错）分泌血管升压素和缩宫素。甲状旁腺细胞（B错）分泌甲状旁腺激素。甲状腺滤泡细胞（D错）分泌甲状腺过氧化物酶。腺垂体细胞（E错）分泌多种激素如生长激素、催乳素、促甲状腺激素、促肾上腺皮质激素、卵泡刺激素和黄体生成素等。